在体外无活性，需要在体内水解开环发挥活性的药物是
A. 阿托伐他汀钙
B. 氟伐他汀钠
C. 瑞舒伐他汀钙
D. 洛伐他汀
E. 普伐他汀钠

正确答案：D。洛伐他汀

解析：本题考查他汀类药物。在体外无活性，需要在体内水解开环发挥活性的药物是洛伐他汀（D对）。洛伐他汀属于前体药物，体外无HMG-CoA还原酶抑制作用，需进入体内后水解发挥活性。阿托伐他汀钙（A错）具有开环的二羟基戊酸侧链。氟伐他汀钠（B错）用吲哚环替代洛伐他汀分子中的双环，并将内酯环打开与钠成盐后得到氟伐他汀钠。瑞舒伐他汀钙（C错）分子中的双环部分改成了多取代的嘧啶环，嘧啶环上引入的甲磺酰基作为氢键接受体和HMG-CoA还原酶形成氢键，增加了与酶的结合能力，抑制作用更强。普伐他汀钠（E错）是在洛伐他汀的基础上将内酯环开环成3，5-二羟基戊酸并与钠成盐，以及将十氢萘环2位的甲基用羟基取代而得的药物。